黄曲霉毒素发生裂解的温度为
A. 70℃
B. 100℃
C. 140℃
D. 200℃
E. 280℃

正确答案：E。280℃

解析：本题考查黄曲霉毒素发生裂解的温度。黄曲霉毒素耐热，在一般烹调加工温度下不被破坏，在280℃（E对ABCD错）时发生裂解。